与吸附力关系最密切的因素是
A. 基托组织面与黏膜的密合程度
B. 是否戴过旧义齿
C. 唾液的质和量
D. 是否用软衬材料
E. 基托的厚度

正确答案：A。基托组织面与黏膜的密合程度

解析：本题考查全口义齿的固位原理-吸附力。与吸附力关系最密切的因素是基托组织面与黏膜的密合程度（A对）。吸附力是两种物体分子之间相互的吸引力。只有基托组织面与黏膜紧密贴合，二者之间才能形成负压和吸附力，接触面积越大、越密合，其吸附力也就越大，因此基托组织面与黏膜的密合程度，是与吸附力关系最密切的因素。是否戴过旧义齿（B错）可能会使颌骨的解剖产生变化，影响全口义齿的就位，但不是与吸附力关系最密切的因素。吸附力的大小与唾液的质和量（C错）有关，若唾液的粘稠度高，流动性小，可加强附着力和内聚力，即增强吸附力，而不是形成吸附力最密切的因素。软衬材料（D错）主要是用于减轻支持组织的创伤，可以增强吸附力，但不是产生吸附力最主要的因素。基托应有一定的厚度（E错），保持其抗挠曲强度，过薄易折裂，过厚患者感觉不适，与吸附力大小无关。